重金属检查法的第一法使用的试剂有
A. 硝酸银试液和稀硝酸
B. 25%氯化钡溶液和稀盐酸
C. 锌粒和盐酸
D. 硫代乙酰胺试液和醋酸盐缓冲液（pH3.5）
E. 硫化钠试液和氢氧化钠试液

正确答案：D。硫代乙酰胺试液和醋酸盐缓冲液（pH3.5）